女，38岁，接触性出血1月余，白带有恶臭，妇科检查，宫颈Ⅱ°糜烂，前唇有5cm×3cm的质地脆赘生物，易出血。子宫正常大，三合诊（-）。确诊后，其临床期别为
A. ⅠA期
B. ⅠB1期
C. ⅠB2期
D. ⅡA期
E. ⅡB期

正确答案：C。ⅠB2期

解析：该患者有接触性出血、白带伴恶臭（宫颈癌常表现为接触性出血，晚期患者因癌组织坏死伴感染，可有大量米泔样或脓性恶臭白带），妇检：宫颈Ⅱ度糜烂，前唇有5cm×3cm（＞4cm）的质地脆赘生物，易出血（外生型子宫颈癌可见息肉状、菜花状赘生物，常伴感染，质脆易出血）。子宫正常大，三合诊阴性（临床癌灶局限于子宫颈，未侵及子宫和宫旁组织），最可能的诊断是子宫颈癌，其临床期别为ⅠB2期（C对）。子宫颈癌临床分期：（1）Ⅰ期（A错）：肿瘤局限在子宫颈（扩展至宫体将被忽略）。ⅠA：镜下浸润癌（所有肉眼可见的病灶，包括表浅浸润，均为ⅠB期），间质浸润深度＜5mm，宽度≤7mm；ⅠA1 间质浸润深度≤3mm，宽度≤7mm；ⅠA2间质浸润深度＞3mm且＜5mm，宽度≤7mm。ⅠB期：临床癌灶局限于子宫颈，或者镜下病灶＞ⅠA；ⅠB1（B错） 临床癌灶≤4cm；ⅠB2（C对）临床癌灶＞4cm。（2）Ⅱ期：肿瘤超越子宫，但未达骨盆壁或未达阴道下1/3。ⅡA（D错）肿瘤侵犯阴道上2/3，无明显宫旁浸润；ⅡA1 临床可见癌灶≤4cm；ⅡA2临床可见癌灶＞4cm。ⅡB期（E错）有明显宫旁浸润，但未达到盆壁。（3）Ⅲ期：肿瘤已扩展到骨盆壁，在直肠指诊时，在肿瘤和盆壁之间无间隙。肿瘤累及阴道下1/3，由肿瘤引起的肾盂积水或肾无功能的所有病例，除非已经知道由其他原因所引起。ⅢA（E错） 肿瘤累及阴道下1/3，没有扩展到骨盆壁。ⅢB：肿瘤扩展到骨盆壁，或引起肾盂积水或肾无功能。（4）Ⅳ期：肿瘤超出了真骨盆范围，或侵犯膀胱和（或）直肠黏膜。ⅣA 肿瘤侵犯邻近的盆腔器官。ⅣB远处转移。